视交叉的中央部损伤出现
A. 双眼对侧半视野同向性偏盲
B. 双眼颞侧视野偏盲
C. 同侧眼全盲
D. 同侧眼鼻侧视野偏盲
E. 同侧眼的瞳孔直接和间接对光反射均消失

正确答案：B。双眼颞侧视野偏盲

解析：视交叉的中央部纤维为双眼视网膜鼻侧半纤维的延续，控制的是双眼颞侧半视野，因而视交叉的中央部损伤出现双眼颞侧视野偏盲（B对）。一侧视束及以后的视觉传导路（视辐射、视区皮质）损伤使同侧眼鼻侧半视觉及对侧眼颞侧半视觉传入障碍，出现双眼病灶对侧半视野同向性偏盲（A错）。一侧视神经损伤使同侧眼全部视觉传入障碍，出现同侧眼全盲（C错）。一侧视交叉外侧部的不交叉纤维损伤使同侧眼鼻侧半视觉传入障碍，出现同侧眼鼻侧视野偏盲（D错）。瞳孔对光反射通过视神经传入、动眼神经传出，一侧动眼神经损伤使同侧瞳孔对光反射弧中断，出现同侧眼的瞳孔直接和间接对光反射均消失（E错）。